兼能安神的开窍药是
A. 朱砂
B. 苏合香
C. 石菖蒲
D. 酸枣仁
E. 琥珀

正确答案：C。石菖蒲

解析：本题考查的是石菖蒲的功效。兼能安神的开窍药是石菖蒲（C对）。石菖蒲：【功效】开窍宁神，化湿和胃。朱砂（A错）：【功效】镇心安神，清热解毒。苏合香（B错）：【功效】开窍辟秽，止痛。酸枣仁（D错）：【功效】养心安神，敛汗。琥珀（E错）：【功效】安神定惊，活血散瘀，利尿通淋。